服用地西泮次晨出现乏力，倦怠等“宿醉”现象，该不良反应是
A. 过敏反应
B. 首剂效应
C. 副作用
D. 后遗效应
E. 特异性反应

正确答案：D。后遗效应

解析：本题考查药品的不良反应。服用地西泮次晨出现乏力，倦怠等“宿醉”现象，该不良反应是后遗效应（D对）。后遗效应是指在停药后，血药浓度已降至最小有效浓度以下时残存的药理效应。例如，服用巴比妥类催眠药后，次晨出现的乏力、困倦等“宿醉”现象；长期应用肾上腺皮质激素，可引起肾上腺皮质萎缩，一旦停药，可出现肾上腺皮质功能低下，数月难以恢复。过敏反应（A错）又称变态反应，是指机体受药物刺激所发生异常的免疫反应，会引起机体生理功能障碍或组织损伤。首剂效应（B错）是指一些患者在初服某种药物时，由于机体对药物作用尚未适应而引起不可耐受的强烈反应。副作用（C错）或副反应是指在药物按正常用法用量使用时，出现的与治疗目的无关的不适反应。特异质反应（E错）也称特异性反应，是指少数特异体质患者对某些药物反应异常敏感。